于残疾状态下所消耗的平均寿命，从而得到无残疾状态下的预期平均生存年数指的是
A. 减寿人年数
B. 无残疾期望寿命
C. 活动期望寿命
D. 伤残调整生命年
E. 健康期望寿命

正确答案：B。无残疾期望寿命